在喹诺酮类抗菌药物的构效关系中，这类药物的必要基团是
A. 1位氮原子无取代
B. 5位有氨基
C. 3位上有羧基和4位上是羰基
D. 8位氟原子取代
E. 7位无取代

正确答案：C。3位上有羧基和4位上是羰基

解析：本题考查喹诺酮类抗菌药。喹诺酮类抗菌药分子中的关键药效团是3位羧基和4位羰基（C对），其能够与DNA螺旋酶和拓扑异构酶Ⅳ结合，发挥作用（ABDE错）。